就全国范围而言，广大农民的饮用水是不够安全的，其危害主要来自
A. 生物性污染和放射性污染
B. 环境化学物和生物地球化学性的污染
C. 生物性、生物地球化学性和放射性污染
D. 生物性、生物地球化学性和环境化学性污染
E. 生物地球化学性、生物性和放射性污染

正确答案：D。生物性、生物地球化学性和环境化学性污染

解析：本题考查农村饮用水的卫生状况。就全国范围而言，广大农民的饮用水是不够安全的，其危害主要来自生物性、生物地球化学性和环境化学性污染（D对ABCE错）。